作用于远曲小管和集合管，直接抑制钠离子选择性通道的药物是
A. 乙酰唑胺
B. 安体舒通
C. 氨苯蝶啶
D. 氢氯噻嗪
E. 呋喃苯胺酸

正确答案：C。氨苯蝶啶

解析：本题考查利尿药。作用于远曲小管和集合管，直接抑制钠离子选择性通道的药物是氨苯蝶啶（C对）。氨苯蝶啶为肾小管上皮细胞Na⁺通道阻滞剂，主要作用于远曲小管末端和集合管，通过阻滞管腔膜Na⁺通道而减少Na⁺的重吸收，同时由于Na⁺的重吸收减少使管腔的负电位降低，导致驱动K⁺分泌的动力减少，抑制了K⁺分泌，因而产生排Na⁺、利尿、保K⁺的作用。乙酰唑胺（A错）为碳酸酐酶抑制剂。安体舒通（B错）即螺内酯，为醛固酮受体拮抗剂。氢氯噻嗪（D错）是中效利尿药。呋喃苯胺酸（E错）即呋塞米，是高效利尿药。